通过圆孔的结构为
A. 眼神经
B. 滑车神经
C. 上颌神经
D. 下颌神经
E. 脑膜中动脉

正确答案：C。上颌神经

解析：通过圆孔的结构为上颌神经（C对）。眼神经（A错）、滑车神经（B错）出入颅的部位为眶上裂。下颌神经（D错）出入颅的部位为卵圆孔。脑膜中动脉（E错）入颅的部位为棘孔。